部分激动药的特点是
A. 对受体亲和力强，无内在活性
B. 对受体亲和力强，内在活性弱
C. 对受体亲和力强，内在活性强
D. 对受无体亲和力，无内在活性
E. 对受体亲和力弱，内在活性弱

正确答案：B。对受体亲和力强，内在活性弱

解析：本题考查作用于受体药物的分类。部分激动药的特点是对受体亲和力强，内在活性弱（B对）。部分激动药具有较强亲和力，但内在活性低（α＜1），与受体结合后只能产生较弱的效应。对受体亲和力强，无内在活性（A错）的是拮抗药。对受体亲和力强，内在活性强（C错）的是完全激动药。